传导躯干、四肢痛、温觉的是
A. 内侧丘系
B. 三叉丘系
C. 脊髓丘系
D. 外侧丘系
E. 锥体束

正确答案：C。脊髓丘系

解析：脊髓丘系（C对）是脊髓丘脑侧束和脊髓丘脑前束的延续，终于丘脑腹后外侧核，传导对侧躯干、肢体的痛、温觉和粗略触压觉。内侧丘系（A错）是由对侧薄束核和楔束核发出的二级感觉纤维，经内侧丘系交叉后形成的，终于丘脑腹后外侧核，传导对侧躯干和肢体的意识性本体感觉和精细触觉。三叉丘系（B错）是由对侧三叉神经脊束核和双侧三叉神经脑桥核（主要为对侧）发出的二级感觉纤维组成的，终于背侧丘脑腹后内侧核，传导对侧头面部皮肤、牙及口、鼻黏膜的痛、温觉，也传递双侧同区域的触压觉。外侧丘系（D错）主要由双侧蜗神经核发出的二级听觉纤维组成，一侧外侧丘系传导双侧听觉冲动。锥体束（E错）主要由皮质核束和皮质脊髓束构成，前者终止于双侧脑神经运动核（P389），支配头面部骨骼肌运动；后者终止于脊髓前角运动神经元（P389），支配四肢肌、躯干肌运动。